感染人体后可引起“恐水病”的病毒是
A. 流行性乙型脑炎病毒
B. 狂犬病病毒
C. 汉坦病毒
D. 登革病毒
E. 麻疹病毒

正确答案：B。狂犬病病毒

解析：狂犬病潜伏期为3～8周（10日至数年）。人发病时的典型临床表现是神经兴奋性增高，吞咽或饮水时喉头肌肉发生痉挛，故又称恐水病。掌握“狂犬病、人乳头瘤病毒”知识点。